以原发病例接触者人数为分母的是
A. 医院感染发生率
B. 医院感染例次发生率
C. 医院感染患病率
D. 医院感染漏报率
E. 医院感染续发率

正确答案：E。医院感染续发率